过敏性疾病患者可出现
A. 红细胞/血红蛋白减少
B. 中性粒细胞增多
C. 嗜酸性粒细胞增多
D. 血小板增多
E. 嗜碱性粒细胞减少

正确答案：C。嗜酸性粒细胞增多

解析：本题考查过敏性疾病。过敏性疾病患者可出现嗜酸性粒细胞增多（C对）。过敏性疾病如支气管哮喘、荨麻疹、药物性皮疹、血管神经性水肿、食物过敏、血清病、过敏性肺炎等表现为嗜酸性粒细胞增多。红细胞/血红蛋白减少（A错）见于消化道溃疡、再生障碍性贫血、骨髓瘤等。中性粒细胞增多（B错）见于急性感染、糖尿病酮症酸中毒、汞中毒、白血病、急性大出血等。血小板增多（D错）见于慢性粒细胞白血病、真性红细胞增多症、急性感染、急性溶血等。嗜碱性粒细胞减少（E错）见于过敏性休克、促肾上腺皮质激素、肾上腺皮质激素应用过量及应激反应。